位于椎体后面的韧带是
A. 前纵韧带
B. 后纵韧带
C. 黄韧带
D. 棘间韧带
E. 棘上韧带

正确答案：B。后纵韧带

解析：后纵韧带（B对）位于椎体后面，前纵韧带（A错）位于椎体前面，黄韧带（C错）位于相邻两椎弓板间。